OR的流行病学含义为
A. 暴露组为非暴露组发病概率的倍数
B. 暴露于某因素的发病率
C. 因素与疾病之间的相关程度
D. 暴露组与非暴露组发病比值

正确答案：C。因素与疾病之间的相关程度

解析：本题考查OR的流行病学含义。OR指暴露者发生疾病的危险性是非暴露者的多少倍。OR＞1，说明暴露与疾病呈正关联，即暴露可增加疾病的危险性，暴露因素是疾病的危险因素；OR＜1，说明暴露与疾病呈负关联，即暴露可降低疾病的危险性，暴露因素是保护因素；OR＝1，表明暴露因素与疾病之间无统计学联系。因此，OR的流行病学含义为：暴露因素与疾病之间的相关程度（C对ABD错）。